正中神经在腕部受损伤时，下列表现中不正确的是
A. 拇指不能对掌
B. 拇指不能伸
C. 拇指外展力弱
D. 鱼际肌萎缩，手掌平坦
E. 拇指、食指(示指)不能屈

正确答案：B。拇指不能伸

解析：正中神经在腕部受损伤时出现腕管综合征，表现为鱼际肌萎缩，手掌变平呈“猿掌”，同时桡侧三个半手指掌面皮肤及桡侧半手掌出现感觉障碍。桡神经损伤导致拇指不能伸（B错，为本题正确选项）。